核桃仁的功效是
A. 补肾，益精，缩尿
B. 补肾，润肺，明目
C. 补肾，清火，滋阴
D. 补肾，活血，续伤
E. 补肾，温肺，润肠

正确答案：E。补肾，温肺，润肠

解析：本题考查的是核桃仁的功效。核桃仁的功效是补肾，温肺，润肠（E对）。核桃仁：【功效】补肾，温肺，润肠。枸杞子：【功效】滋补肝肾，明目，润肺（B错）。功效为补肾，益精，缩尿（A错）、补肾，清火，滋阴（C错）或补肾，活血，续伤（D错）的中药，2022年考试指南未明确说明。